口腔黏膜白斑临床上可有下述表现，除了
A. 白色或灰白色的均质斑块或呈皱纸状斑块
B. 白色不规则隆起伴有乳头状突起
C. 呈颗粒状红白间杂病损
D. 在白色斑块的基础上有溃疡形成
E. 白色凝乳状假膜

正确答案：E。白色凝乳状假膜

解析：本题考查口腔黏膜白斑的临床表现。白色凝乳状假膜（E错，为本题的正确答案）是白色念珠菌病的口腔表现。白斑的临床表现可分为斑块状、皱纹纸状、颗粒状、疣状和溃疡状。白色或灰白色的均质斑块或呈皱纸状斑块（A对）为斑块状或皱纹纸状白斑的病损表现。白色不规则隆起伴有乳头状突起（B对）为疣状白斑的病损表现。呈颗粒状红白间杂病损（C对）为颗粒状白斑的病损表现。在白色斑块的基础上有溃疡形成（D对）为溃疡状白斑的病损表现。